依据咳嗽、咳痰或伴喘息，每年发病3个月，连续2年或2年以上，排除其他慢性气道疾病即可诊断为
A. 慢性支气管炎
B. 慢性支气管哮喘
C. 心源性哮喘
D. 阻塞性肺气肿
E. 肺心病

正确答案：A。慢性支气管炎

解析：慢性支气管炎是气管、支气管黏膜及其周围组织的慢性非特异性炎症。依据咳嗽、咳痰或伴喘息，每年发病3个月，连续2年或2年以上，排除其他慢性气道疾病即可诊断。掌握“慢性支气管炎”知识点。